第二鳃裂囊肿常位于
A. 乳突附近
B. 下颌角附近
C. 颈前正中
D. 颈根部
E. 舌骨水平，胸锁乳突肌上1/3前缘附近

正确答案：E。舌骨水平，胸锁乳突肌上1/3前缘附近

解析：第二鳃裂囊肿常位于颈上部，大多在舌骨水平，胸锁乳突肌上1/3前缘附近。掌握“甲状舌管囊肿及鳃裂囊肿”知识点。